男，42岁，牙龈出血疼痛3天，口臭，检查：个别牙龈乳头有灰白色的坏死物。若诊断为坏死性龈炎，患者可出现如下体征，除外
A. 口腔呈腐败性口臭
B. 低热
C. 身体抵抗力下降
D. 颌下淋巴结肿大
E. 末梢血出现原幼细胞

正确答案：E。末梢血出现原幼细胞

解析：本题考查坏死性龈炎的体征。末梢血出现原幼细胞（E错，为本题的正确答案）是白血病的特征性表现，该患者已诊断为坏死性龈炎，虽然有自发性出血，但是血液是正常的。坏死性龈炎由于组织坏死有典型的腐败性口臭（A对）；炎症感染可出现低热（B对）、身体抵抗力下降（C对）等全身症状；炎症引流至下颌下淋巴结、颌下淋巴结可引起淋巴结的炎症、肿大（D对）。